菌斑控制指标百分比中属基本被控制按的是
A. 0.05
B. 0.1
C. 0.15
D. 0.2
E. 0.25

正确答案：D。0.2

解析：本题考查菌斑控制。菌斑控制指标百分比中属基本被控制按的是20%（D对）。菌斑记录卡能反应患者自我控制菌斑效果的信息。通常，患者在首次菌斑染色记录时，阳性百分率较高，但接受口腔卫生指导后，若能认真的按要求执行，菌斑记录的百分率会明显下降，若达到小于20%，则属基本被控制。